两侧髂嵴最高点的连线平对
A. 第2腰椎棘突
B. 第2腰椎体
C. 第3腰椎棘突
D. 第3腰椎体
E. 第4腰椎棘突

正确答案：E。第4腰椎棘突

解析：两侧髂嵴最高点的连线约平第 4 腰椎棘突，是计数椎骨的标志（E对）。